某山区为碘缺乏病的流行地区，如果已经引起了群众的重视，但群众不了解病因，应重点采取哪项措施
A. 利用媒体宣传，引起注意
B. 积极强化正确的行为
C. 提供碘盐的使用方法
D. 进行知识的普及教育
E. 以上都不能达到目的

正确答案：D。进行知识的普及教育